人类工效学的研究
A. 以职业人员为中心
B. 以环境为中心
C. 以教育为中心
D. 以机器设备为中心
E. 以管理为中心

正确答案：A。以职业人员为中心